后牙的根管工作长度是指
A. 牙实际长度
B. 牙根管长度
C. X片上的牙齿长度
D. 洞缘某点到根尖端长度
E. 洞缘某点到根尖狭窄部长度

正确答案：E。洞缘某点到根尖狭窄部长度

解析：后牙的根管工作长度：后牙的窝洞边缘的某一点到根管的根尖狭窄部（即根管的牙本质－牙骨质界）的距离。掌握“牙髓根尖周病的治疗总论”知识点。